现行药品管理法律和行政法规确定的行政许可项目不包括
A. 药品检验人员执业许可
B. 药品生产许可
C. 进口药品上市许
D. 执业药师执业许可

正确答案：A。药品检验人员执业许可

解析：本题考查的是药品行政许可事项。现行药品管理法律和行政法规确定的行政许可项目不包括药品检验人员执业许可（A错，为本题正确答案）。药品行政许可事项：根据《药品管理法》《药品管理法实施条例》《麻醉药品和精神药品管理条例》等法律、行政法规以及其他设定行政许可的相关法律依据，国家对药品注册、安全监管与稽查设定了一系列行政许可项目。如：药品上市许可（C对），表现形式为颁发药品注册证书；药品生产许可（B对），表现形式为颁发《药品生产许可证》和《医疗机构制剂许可证》；药品经营许可，表现形式为颁发《药品经营许可证》；国务院行政法规确认了执业药师执业许可（D对），表现形式为颁发《执业药师注册证》。